分子为对称结构的静脉麻醉药物是
A. 丙泊酚
B. 盐酸丁卡因
C. 盐酸布比卡因
D. 盐酸利多卡因
E. 依托咪酯

正确答案：A。丙泊酚